对高血压合并糖尿病者宜选用
A. β受体阻断剂和血管紧张素转换酶抑制剂
B. 血管紧张素转换酶抑制剂或血管紧张素Ⅱ受体阻断剂
C. 硝普钠或硝酸甘油
D. 利尿剂或醛固酮受体拮抗剂
E. α受体阻断剂或利尿剂

正确答案：B。血管紧张素转换酶抑制剂或血管紧张素Ⅱ受体阻断剂

解析：本题考查抗高血压药。对高血压合并糖尿病者宜选用血管紧张素转换酶抑制剂或血管紧张素Ⅱ受体阻断剂（B对）。高血压合并糖尿病首先考虑使用ACEI或ARB；如需联合用药，应以ACEI或ARB为基础，加用利尿剂或二氢吡啶类CCB。β受体阻断剂（A错）用于高血压合并心力衰竭者。硝普钠或硝酸甘油（C错）用于高血压危象者。利尿剂或醛固酮受体拮抗剂（D错）用于高血压合并脑血管病患者。α受体阻断剂（E错）适用高血压伴前列腺增生患者，心力衰竭者慎用。